不属于腋动脉的直接分支是
A. 胸肩峰动脉
B. 旋肩胛动脉
C. 胸外侧动脉
D. 胸上动脉
E. 肩胛下动脉

正确答案：B。旋肩胛动脉

解析：胸肩峰动脉（A对）、胸外侧动脉（C对）、胸上动脉（D对）、肩胛下动脉（E对）均为腋动脉的直接分支。旋肩胛动脉（B错，为本题正确答案）和胸背动脉为肩胛下动脉的直接分支。